用盐酸滴定液滴定氨水时，使用的指示剂是
A. 甲基橙
B. 铬黑T
C. 酚酞
D. 淀粉
E. 硫酸铁铵

正确答案：A。甲基橙

解析：本题考查酸碱滴定法。用盐酸滴定液滴定氨水时，使用的指示剂是甲基橙（A对）。盐酸与氨水产物为氯化铵，氯化铵水解呈酸性，故达到滴定终点时溶液偏酸，应采用酸性变色范围的指示剂甲基橙。酚酞（C错）为碱性变色范围指示剂，铬黑T（B错）、淀粉（D错）、硫酸铁铵（E错）不是常用的酸碱指示剂。